已知双链DNA中一条链的A=25%，C=35%，其互补链的碱基组成应是
A. T和G60%
B. A和G60%
C. C和G35%
D. T和C35%
E. T和G35%

正确答案：A。T和G60%